男，19岁。初发肾病综合征，应用泼尼松60mg/d治疗8周，水肿无明显好转，复查尿蛋白仍大于3.5g/d，肾活检提示微小病变型肾病。下一步最适宜的治疗是
A. 加入人血白蛋白
B. 大剂量静脉使用免疫球蛋白
C. 加用ACEI
D. 加用免疫抑制剂
E. 增加泼尼松剂量

正确答案：D。加用免疫抑制剂

解析：90%微小病变型肾病病例对糖皮质激素治疗敏感，若糖皮质激素治疗无效，下一步最适宜的治疗是加用免疫抑制剂（D对）。加入人血白蛋白（A错）适用于抗感染治疗。大剂量静脉使用免疫球蛋白（B错）适用于治疗原发性免疫球蛋白缺乏症、继发性免疫球蛋白缺陷病和自身免疫性疾病。加用ACEI（C错）适用于对症治疗。增加泼尼松剂量（E错）对“激素抵抗型”无效且易并发副作用。